肾病综合征易出现并发症
A. 心力衰竭
B. 肾性贫血
C. 高血压脑病
D. 肾静脉血栓
E. 肾周脓肿

正确答案：D。肾静脉血栓

解析：肾病综合征容易发生血栓、栓塞并发症，其中以肾静脉血栓最为常见（D对）。